对半卡环中代替舌侧卡环臂常用
A. 颊侧基托
B. 舌侧基托
C. 近中邻面板
D. 远中邻面板
E. 以上均可以

正确答案：B。舌侧基托

解析：对半卡环：由颊、舌侧两个相对的卡环臂和近、远中支托组成，用于前后有缺隙、孤立的前磨牙或磨牙上。临床上常用舌侧基托代替舌侧卡环臂，起到对抗臂的作用。掌握“局部义齿固位体”知识点。